口腔颌面部软组织对放射线平均耐受量约为6～8周给予
A. 20～40Gy
B. 40～60Gy
C. 60～80Gy
D. 80～100Gy
E. 100Gy以上

正确答案：C。60～80Gy

解析：本题考查放射性颌骨坏死的病因。口腔颌面部软组织对放射线平均耐受量约为6～8周给予60～80Gy（C对）。口腔软组织对射线平均耐受量为6～8周内给予60～80Gy，口腔颌面部放射性骨坏死的临界性剂量指标为50Gy。